不含乙醇，内服外用均可的是
A. 碘甘油
B. 薄荷醑
C. 地高辛口服液
D. 复方磷酸可待因糖浆
E. 薄荷水

正确答案：E。薄荷水

解析：本题考查芳香水剂。薄荷水（E对）的成分为薄荷油、滑石粉和蒸馏水，不含乙醇，内外服均可。